发汗解暑宜水煎凉服，利水退肿须浓煎服的中药是
A. 麻黄
B. 藁本
C. 香薷
D. 羌活
E. 浮萍

正确答案：C。香薷

解析：本题考查香薷的用法用量。发汗解暑宜水煎凉服，利水退肿须浓煎服的中药是香薷（C对）。香薷【用法用量】内服：煎汤，3～10g；或入丸散。外用：适量，捣敷。或煎汤含漱。发汗解暑宜水煎凉服，利水退肿须浓煎服或为丸服。麻黄（A错）【用法用量】内服：煎汤，1.5～10g；或入丸散。外用：适量，研末吹鼻，或研末敷。解表宜生用，平喘宜蜜炙用或生用。小儿、年老体弱者宜用麻黄绒。藁本（B错）【用法用量】内服：煎汤，2～10g；或入丸散。外用：适量，煎水洗或研末调涂。羌活（D错）【用法用量】内服：煎汤，3～10g；或入丸散。浮萍（E错）【用法用量】内服：煎汤，3～10g，鲜品15～30g；或入丸散，或捣汁饮。